以血管外给药（如口服）的AUC和静脉注射的AUC进行比较，则可得该药的
A. 半数有效剂量
B. 绝对生物利用度
C. 半数致死量
D. 相对生物利用度
E. 治疗指数

正确答案：B。绝对生物利用度

解析：以血管外给药（如口服）的AUC和静脉注射的AUC进行比较，则可得该药的绝对生物利用度。掌握“药物消除及重要参数”知识点。